定量研究与定性研究的区别叙述正确的是
A. 在实际研究中，定量研究和定性研究经常结合在一起使用
B. 定量研究资料可以用统计方法处理和分析，定性研究资料则不能
C. 定量研究适用于大样本，定性研究适用于小样本
D. 定量研究适用于任何研究，而定性研究只适用于社会科学方面的研究

正确答案：B。定量研究资料可以用统计方法处理和分析，定性研究资料则不能

解析：本题考查定量研究与定性研究的区别。定量研究是通过调查收集人群发生某种事件的数量指标，或者探讨各种因素与疾病和健康的数量依存关系的研究。定性研究是一种在自然的情境下，从整体的角度深入探讨和阐述被研究事物的特点及其发生和发展规律，以揭示事物的内在本质的一类研究方法。二者的区别在于定量研究资料可以用统计方法处理和分析，定性研究资料则不能（B对ACD错）。定量研究资料的分析主要是获得相应的量化指标，用指标表述结果，分析主要采用流行病学与卫生统计学的方法。定性研究所获得的资料主要是文字描述或叙述性的资料，很难用统计指标表达。